治疗乳汁缺乏应首选
A. 少商
B. 少泽
C. 中冲
D. 隐白
E. 大敦

正确答案：B。少泽

解析：治疗乳汁缺乏应首选少泽穴，少泽穴是通乳效穴，少泽穴与膻中、乳根穴合用，经脉得通，气血得养，乳少自愈（B对ACDE错）。少商治疗肺系实热证；癫狂、昏迷（A错）。隐白治疗妇科病；便血尿血等慢性出血证；癫狂、多梦；惊风；腹满、暴泻（D错）。中冲治疗中风昏迷、舌强不语、中暑、昏厥、小儿惊风等急症（C错）。大敦主治疝气、少腹痛；泌尿系病证；月经病及前阴病；癫痫（E错）。